比较两种病人痰中嗜酸性粒细胞含量有无差别的假设检验，其H₀为
A. 两种病人痰中嗜酸性粒细胞总体均数相等
B. 两种病人痰中嗜酸性粒细胞总体均数不等
C. 两种病人痰中嗜酸性粒细胞含量总体分布相同
D. 两种病人痰中嗜酸性粒细胞含量总体分布不同
E. 两种病人嗜酸性粒细胞含量样本均数相等

正确答案：C。两种病人痰中嗜酸性粒细胞含量总体分布相同